患者，女，25岁，产后2个月，哺乳期。因尿路感染需要给予抗感染治疗，首选的药物是
A. 阿米卡星
B. 左氧氟沙星
C. 多西环素
D. 头孢呋辛
E. 复方磺胺甲噁唑

正确答案：D。头孢呋辛

解析：本题考查哺乳期抗菌药物的选择。头孢呋辛（D对）为哺乳期尿路感染抗感染治疗的首选药。大多数抗菌药物都能进入乳汁，但进入乳儿体内的量很小，不会对乳儿产生严重危害。偶有过敏反应、腹泻等情况。青霉素类对乳儿安全。头孢菌素类在乳汁中含量甚微，但第四代头孢菌素类如头孢匹罗、头孢吡肟例外。大环内酯类100%分泌至乳汁。氨基糖苷类如阿米卡星（A错），对乳儿的影响不详，可能具有潜在危害，不宜应用。喹诺酮类对乳儿骨关节有潜在危害，不宜应用。磺胺类如磺胺甲噁唑（E错）在乳汁中的浓度与血浆中一致，在新生儿黄疸时，可促使发生核黄疸。氯霉素在乳汁中的浓度为血清中的1/2，有明显骨髓抑制作用，可引起灰婴综合征，故哺乳期禁用。哺乳期妇女禁用的抗感染药物有链霉素、氯霉素、多西环素（C错）、环丙沙星、左氧氟沙星（B错）、磺胺甲噁唑等。